肛门三角
A. 前界为耻骨联合下缘
B. 两侧界为耻骨下支
C. 有肛管通过
D. 后界为两侧坐骨结节前缘的连线
E. 无

正确答案：C。有肛管通过

解析：肛门三角的前界为两侧坐骨结节前缘的连线（AD错），并有肛肠通过（C对）。